可通过测定膨胀度进行鉴定的中药材有
A. 决明子
B. 五倍子
C. 葶苈子
D. 蟾酥
E. 蛤蟆油

正确答案：C、E。葶苈子；蛤蟆油